心源性休克病人心率慢，宜选用哪种药物治疗
A. 低分子右旋糖苷
B. 酚妥拉明
C. 多巴酚丁胺
D. 西地兰
E. 糖皮质激素

正确答案：C。多巴酚丁胺

解析：心源性休克病人心率慢，宜选用多巴酚丁胺（C对）治疗。多巴酚丁胺属血管收缩剂，可通过兴奋β受体发挥对心肌的正性肌力作用，增加心脏的每搏输出量和心率，使心输出量增加，从而迅速提高血压，改善各器官血流灌注。低分子右旋糖酐（A错）为血浆代用品，主要作用是扩充血容量，心源性休克患者心功能下降，若单纯扩容会加重心脏负荷。酚妥拉明（B错）为血管扩张剂，应在补充血容量的基础上应用，否则可加重休克。西地兰（D错）属洋地黄类药物，虽可增强心肌收缩力，但减慢心率。糖皮质激素（E错）主要用于感染性休克和其他较严重的休克，可增加心肌收缩力，增加心排血量，但其扩张血管的作用会使回心血量进一步减少，可能加重心源性休克。